女孩，2岁，体检发现心脏杂音就诊，平素体健，查体：左缘第2肋间闻及2/6级喷射性收缩期杂音，第二心音固定分裂，ECG电轴右编，Vl导联呈rsR波型。血流动力学改变表现为
A. 左心房增大
B. 右心房、右心室增大
C. 左心室增大
D. 左心房、左心室增大
E. 左心房、左心室，右心室增大

正确答案：B。右心房、右心室增大

解析：患儿2岁，平素体健，查体：胸骨左缘第2肋间闻及2/6级喷射性收缩期杂音（系肺动脉相对性狭窄所致），第二心音固定分裂（房缺典型体征）。心电图示：ECG电轴右偏，Vl导联呈rsR波型（以上提示右心室增大），最可能的诊断是房间隔缺损。房缺表现为左向右分流，分流量尤其与心室顺应性呈正相关。随患儿成长，右室壁变薄，顺应性增大，充盈阻力减小，充盈量增多，故心室舒张时，右室、右房逐渐增大（B对）。快速记忆：①室缺（左右室增大，肺动脉高压）：轻度不明显；中度：左室增大为主，肺动脉扩张；重度：右室增大为主，肺动脉明显突出。②房缺：右房、室增大。③动脉导管未闭：除右心房均增大。④法洛四联征：右室增大为主。